患者，男，52岁，身高168cm，体重85kg，痛风病史6年。近日因多饮、多尿就诊，实验室检查：空腹血糖7.8mmol/L（正常值：3.9～6.1mmol/L），餐后血糖148mmol/L（正常值：<7.8mmol），血尿酸580㎛ol/L（正常值：男性180～440mol/1），血LDL-C3.7mmol/L（正常值：2.1～3.lmmol/L），肌酐清除率100ml/min。颈动脉彩超提示：动脉粥样硬化，有混合性脂质斑块。临床诊断2型糖尿病、痛风、高脂血症、动脉粥样硬化症。该患者首选的降糖药是
A. 格列齐特
B. 阿卡波糖
C. 甘精胰岛素
D. 那格列奈
E. 二甲双胍

正确答案：E。二甲双胍

解析：本题考查降糖药。该患者身高168cm，体重85kg，属于肥胖。二甲双胍（E对）适合2型肥胖型糖尿病患者。格列齐特（A错）主要用于2型非肥胖型糖尿病患者。阿卡波糖（B错）可作为单纯餐后血糖高，而空腹和餐前血糖不高的首选。胰岛素（C错）可用于1型糖尿病患者的胰岛素分泌不足。那格列奈（D错）可在2型非肥胖型糖尿病患者有良好的胰岛β细胞储备功能、无高胰岛素血症时应用。